含有相同或相似抗原表位的不同抗原称为
A. 共同抗原
B. 异嗜性抗原
C. 同种异型抗原
D. 自身抗原
E. 独特型抗原

正确答案：A。共同抗原